多生牙最常见于
A. 下颌磨牙区域
B. 下颌前牙区域
C. 上颌前磨牙区
D. 上颌磨牙区
E. 上颌前牙区域

正确答案：E。上颌前牙区域

解析：本题考查迟萌、多生牙和融合牙。多生牙最常见发生于上颌前牙区域（E对），上颌发生率大约是下颌发生率的8倍，最多见的牙齿是正中牙。